1分子丙酮酸被彻底氧化成CO₂和H₂O，同时生成ATP的分子数
A. 12.5
B. 13
C. 14
D. 15
E. 16

正确答案：A。12.5

解析：1mol丙酮酸在线粒体内彻底氧化经过以下步骤：①丙酮酸→乙酰CoA（+2.5molATP）；②异柠檬酸→ɑ-酮戊二酸（+2.5molATP）；③ɑ-酮戊二酸→琥珀酰CoA（+2.5molATP）；④琥珀酰CoA→琥珀酸（+1molGTP）；⑤琥珀酸→延胡索酸（+1.5molATP）；⑥苹果酸→草酰乙酸（+2.5molATP）。故1mol丙酮酸在线粒体彻底氧化生成2.5+2.5+2.5+1+1.5+2.5=12.5molATP，故选A）。